提净后润燥软坚、消导，下气通便作用增强的药材是
A. 艾叶
B. 朱砂
C. 藤黄
D. 黄芩
E. 芒硝

正确答案：E。芒硝

解析：本题考查的是芒硝的炮制作用。提净后润燥软坚、消导，下气通便作用增强的药材是芒硝（E对）。芒硝：【炮制作用】芒硝味咸、苦，性寒。归胃、大肠经。具有泻热通便，润燥软坚，清火消肿的功能。将天然产品加热水溶解过滤，除去泥沙及不溶性杂质，将滤液静置，析出结晶是芒硝的粗制品（朴硝），杂质较多，不宜内服，以消积散痈见长，多外用于乳痈。朴硝用萝卜煮制后所得的芒硝，可提高其纯净度，同时缓和其咸寒之性，并借萝卜消积滞，化痰热，下气，宽中作用，以增强芒硝润燥软坚，消导，下气通便之功。用于实热便秘，大便燥结，积滞腹痛，肠痈肿痛。艾叶（A错）：【炮制作用】艾叶味辛、苦，性温；有小毒。归肝、脾、肾经。具有散寒止痛、温经止血的功效。①生艾叶性燥，祛寒燥湿力强，但对胃有刺激性，故多外用。②制绒是便于制剂和应用。艾绒为制备艾条、艾炷的原料。功用与艾叶相似，药力较优。因其质地绵软，性温走窜，气味芳香，可装入布袋中，以袋兜腹，治老人丹田气弱，脐腹畏寒，小儿受寒，腹痛作泻。③醋炙品温而不燥，并能缓和对胃的刺激性，增强逐寒止痛的作用。④艾叶炭辛散之性大减，对胃的刺激性缓和，温经止血的作用增强。可用于崩漏下血，月经过多，或妊娠下血。⑤醋炙艾叶炭，温经止血的作用增强。用于虚寒性出血。朱砂（B错）：【炮制作用】朱砂味甘，性微寒；有毒。归心经。具有清心镇惊、安神解毒的功能。水飞朱砂可使药物达到纯净，极细，便于制剂及服用。内服多用于心悸易惊，失眠多梦，癫痫肿毒等。藤黄（C错）：【炮制作用】藤黄味酸、涩，性寒；有大毒。归胃、大肠经。生品有大毒，不能内服。具有消肿排脓、散瘀解毒、杀虫止痒的功能。外用治疗痈疽肿毒，顽癣。制藤黄毒性降低，可供内服。并可保证药物的净度。用于跌打损伤，金疮肿毒，肿瘤。黄芩（D错）：【炮制作用】黄芩性味苦寒。归肺、胆、脾、胃、大肠、小肠经。具有清热燥湿、泻火解毒、止血、安胎的功能。黄芩蒸或沸水煮的目的是灭活酶，防止苷类成分分解，以保存药效，又能使药物软化，便于切片。①生黄芩清热泻火解毒力强，用于热病，湿温，黄疸，泻痢、乳痈发背。②酒黄芩入血分，并可借黄酒升腾之力，用于上焦肺热及四肢肌表之湿热；同时，因酒性大热，可缓和黄芩的苦寒之性，以免伤害脾阳，导致腹泻。③黄芩炭以清热止血为主，用于崩漏下血，吐血衄血。